赵某，男，45岁，阵发性呼气性呼吸困难，烦躁不安，持续6小时，氨茶碱治疗无效，痰黏，有哮喘病史。查体：满肺哮鸣音，可见肺气肿征。应首先采取的治疗方法是
A. 大剂量青霉素静点
B. 西地兰静脉推注
C. 吗啡皮下注射
D. 地塞米松静滴
E. 沙丁胺醇雾化吸入

正确答案：D。地塞米松静滴

解析：青年男性患者，既往有哮喘病史，出现阵发性呼气性呼吸困难，烦躁不安，持续6小时，氨茶碱无效，此为哮喘急性重度发作，重度至严重哮喘发作时应及早应用琥珀酸氢化可地松，注射后4～6小时起作用，亦可用地塞米松（D对）。青霉素属于抗生素，适用于哮喘并发感染者，选择有效抗生素，积极控制感染是治疗危重症哮喘的有效措施，本题患者未并发感染（A错）。西地兰可增加心肌收缩力、减慢心率，适用于慢性心力衰竭、房颤、阵发性室上性心动过速患者（B错）。吗啡是阿片类药物，可用于重度癌性疼痛，亦可镇静止咳，可用于心衰（C错）。沙丁胺醇属于短效β₂受体激动剂，适用于缓解轻中度急性哮喘症状（E错）。